膀胱的位置
A. 成年人位于小骨盆腔的前部
B. 新生儿位置较成年人高
C. 老年人的膀胱位置较低。
D. 膀胱充盈时，可高出耻骨联合以上
E. 上述全部正确

正确答案：E。上述全部正确

解析：小骨盆是骨盆的下半部分，耻骨联合上缘是大小骨盆分界线（P50）的一部分，膀胱位于耻骨联合后方，充盈时可上移至耻骨联合上方（B对），故其位于小骨盆腔前方（A对）。膀胱位置关系为，新生儿高于成年人（D对），成年人高于老年人（C对, 故E为本题正确答案）。